某批次青霉素钠原料1mg相当于1670单位效价，生产规格为80万U/支青霉素钠产品，每只所需装载量是
A. 2.088mg
B. 1.33mg
C. 1.33g
D. 0.48g
E. 0.48mg

正确答案：D。0.48g

解析：本题考查效价。由题干可知，1mg=1670单位效价，现有80万单位的青霉素钠，按称重应为，800000/1670=480毫克=0.48g（D对）。效价是指某一物质引起生物反应的功效单位。理论效价是指抗生素纯品的重量与效价单位的折算比率，一些常用抗生素的理论效价有：四环素碱 1082单位/mg；青霉素钠 1670单位/mg；青霉素钾1598单位/mg；普鲁卡因青霉素1009单位/mg等。